女，60岁，颈部肿块4月，生长快，无疼痛，查体发现甲状腺右叶直径3cm的肿块，质硬，边界不清，吞咽时活动度小。以下体征中，对诊断最有意义的是
A. 心脏扩大
B. 气管移位
C. 颈部淋巴结肿大
D. 心率快
E. 脉压增大

正确答案：C。颈部淋巴结肿大

解析：老年女性患者，颈部出现生长迅速的无痛性肿块，质地较硬，且与周围组织分界不清，活动度小，诊断考虑甲状腺恶性肿瘤。颈部淋巴结肿大（C对）表明原发灶出现转移，对诊断甲状腺恶性肿瘤最有意义。心脏扩大（A错）、心率快（D错）、脉压增大（E错）均为甲状腺毒症的表现，而甲状腺恶性肿瘤一般无上述表现。气管移位（B错）多由颈部体积较大的肿块压迫气管所致，可由甲状腺巨大肿瘤、巨大甲状腺肿等因素所致，对诊断甲状腺恶性肿瘤意义欠佳。